公共场所的主管部门应当履行以下职责，但除外
A. 建立卫生管理制度
B. 配备专职或者兼职卫生管理人员
C. 对所属经营单位的卫生状况进行经常性检查:
D. 对所属经营单位的卫生状况进行经常性检查，并提出必要的条件
E. 建立卫生责任制度

正确答案：E。建立卫生责任制度